钠通道阻滞剂的抗心律失常药物有
A. 盐酸美西律
B. 卡托普利
C. 奎尼丁
D. 盐酸普鲁卡因胺
E. 普萘洛尔

正确答案：A、C、D。盐酸美西律；奎尼丁；盐酸普鲁卡因胺

解析：本题考查钠通道阻滞剂。盐酸美西律（A对）、奎尼丁（C对）、盐酸普鲁卡因胺（D对）属于钠通道阻滞剂的抗心律失常药。盐酸美西律为钠通道阻滞剂中的Ib类抗心律失常药。奎尼丁、盐酸普鲁卡因胺均为钠通道阻滞剂中的Ia类抗心律失常药。卡托普利（B错）为血管紧张素转换酶抑制剂（ACEI）。普萘洛尔（E错）为β受体阻断剂。